分布于盆腔脏器的副交感神经节前纤维
A. 迷走神经的分支
B. 内脏大神经
C. 腰内脏神经
D. 盆内脏神经
E. 内脏小神经

正确答案：D。盆内脏神经

解析：盆内脏神经（D对），随盆丛分支分布到盆腔脏器，在脏器附近或脏器壁内的副交感神经节交换神经元，节后纤维支配结肠左曲以下的消化管和盆腔脏器。内脏大神经（B错）和内脏小神经（E错）由节前纤维组成。